心导管检查右心室血氧含量高于右心房的先心病是
A. 房间隔缺损
B. 室间隔缺损
C. 动脉导管未闭
D. 法洛四联症
E. 肺动脉狭窄

正确答案：B。室间隔缺损

解析：室间隔缺损（B对）的心导管检查结果示右心室水平血氧含量高于右心房0.9%容积以上，偶尔导管可通过缺损到达左心室。房间隔缺损（A错）的心导管检查结果示右心房血氧含量超过腔静脉平均血氧含量1.9%容积以上，右心导管也可经过缺损进入左心房。动脉导管未闭（C错）的心导管检查可发现肺动脉血氧含量较右心室为高。法洛四联症（D错）患儿一般不需要做心导管检查，除非存在外周肺动脉分支发育不良及体肺侧支。肺动脉狭窄（E错）的心导管检查结果示右心室压力明显增高，可与体循环压力相等，而肺动脉压力明显降低，心导管从肺动脉向右心室退出时的连续曲线显示明显的无过渡区的压力阶差。